防止心房颤动患者血栓形成的药物是
A. 普萘洛尔
B. 环丙沙星
C. 阿托品
D. 华法林
E. 阿司匹林

正确答案：D。华法林

解析：华法林（D对）属于香豆素类凝血酶抑制药，抑制维生素K在肝内转化，从而影响凝血过程，主要用于防治血栓栓塞性疾病如房颤所致血栓栓塞（P190、九版药理学P265）。普萘洛尔（A错）为β受体阻断药，主要用于减慢心率和降低血压（P206、九版药理学P93）。环丙沙星（B错）属于氟喹诺酮类抗菌药，主要用于对其他抗菌药物产生耐药的革兰阴性杆菌所致的呼吸道、泌尿生殖道、消化道、骨与关节和皮肤软组织感染（九版药理学P403）。阿托品（C错）可竞争性拮抗M胆碱能受体，作用广泛，如用于缓慢型心律失常，抗感染性休克等（九版药理学P65）。阿司匹林（E错）可以抑制COX-1和COX-2，可解热镇痛抗风湿，抑制血小板聚集，抗血栓形成（九版药理学P173）。